某糖尿病患者，血气分析结果如下：pH7.30.PaCO₂4.5kPa(34mmHg),HCO₃⁻16mmoI/L.血Na⁺140mmol/L,CL⁻104mmol/L,K⁺4.5mmol/L,应诊断为
A. AG增高性代谢性酸中毒
B. AG正常性代谢性酸中毒
C. AG增高性代谢性酸中毒合并呼吸性碱中毒
D. AG增高性代谢性酸中毒合并代谢性碱中毒
E. AG正常性代谢性酸中毒合并呼吸性碱中毒

正确答案：A。AG增高性代谢性酸中毒

解析：pH<7.35所以发生酸中毒，HCO₃⁻浓度下降（正常为22~27 mmoI/L），PaCO₂正常（正常范围为33~46 mmHg），所以是HCO₃⁻浓度下降导致的PH下降，为代谢性酸中毒，AG==Na+- (HCO₃⁻+Cl-）=20 mmol /L>16mmol /L,所以是AG增高性代谢性酸中毒（A对）。